既补血止血，又滋阴润肺的药是
A. 阿胶
B. 玉竹
C. 熟地
D. 仙鹤草
E. 北沙参

正确答案：A。阿胶

解析：本题考查阿胶的功效。既补血止血，又滋阴润肺的药是阿胶（A对）。阿胶【功效】补血止血，滋阴润燥。玉竹（B错）【功效】滋阴润肺，生津养胃。熟地黄（C错）【功效】补血滋阴，补精益髓。仙鹤草（D错）【功效】收敛止血，止痢，截疟，解毒，杀虫，补虚。北沙参（E错）【功效】养阴清肺，益胃生津。